询证医学结论的应用范围包括
A. 用于诊疗指南和药品目录的制定
B. 用于药品质量的检定
C. 用于新药研发和临床评价
D. 用于药品价格的制定
E. 用于疾病的诊断与治疗

正确答案：A、C、E。用于诊疗指南和药品目录的制定；用于新药研发和临床评价；用于疾病的诊断与治疗

解析：本题考查循证医学的应用范围。循证医学的主要应用如下：1.管理医疗：对同类病人的诊断（E对）、治疗方法进行规范化管理（A对）。2.卫生政策。3.卫生技术评价。4.指导临床实践（C对）。5.药物研究与应用。